以下哪个是大隐静脉的属支
A. 小隐静脉
B. 闭孔静脉
C. 腹壁浅静脉
D. 腹壁下静脉
E. 股深静脉

正确答案：C。腹壁浅静脉

解析：腹壁浅静脉（C对）、股内侧浅静脉、股外侧浅静脉、阴部外静脉和旋髂浅静脉为大隐静脉的5条属支。